单侧动眼神经损害可出现的表现是
A. 单侧眼睑下垂
B. 单侧额纹消失
C. 单侧鼻唇沟浅
D. 单侧舌肌萎缩
E. 单侧角膜反射消失

正确答案：A。单侧眼睑下垂

解析：单侧动眼神经损害可出现的表现是单侧眼睑下垂（A对）。动眼、滑车和展神经损害表现：眼睑下垂、眼外肌麻痹、眼震、瞳孔异常。